关于匙形器刮治操作过程不正确的是
A. 放入牙周袋时应使工作端的平面与牙根面平行
B. 到达袋底后与根面间逐渐成45°角，以探查根面牙石
C. 到达袋底后与根面间逐渐成45°角，以刮除袋壁肉芽
D. 然后与根面成80°角，进行刮治
E. 操作完成后，仍回到与根面平行的位置，取出器械

正确答案：C。到达袋底后与根面间逐渐成45°角，以刮除袋壁肉芽

解析：本题考查匙形器刮治的操作过程。关于匙形器刮治操作过程不正确的是到达袋底后与根面间逐渐成45°角，以刮除袋壁肉芽（C错，为本题的正确答案）。匙形器放入牙周袋时应使工作端的平面与牙根面平行（A对），到达袋底后与根面间逐渐成45°角，以探查根面牙石（B对），探到牙石根放后，然后与根面成80°角，进行刮治（D对），在刮除龈下结石的同时刮除袋壁肉芽组织。操作完成后，仍回到与根面平行的位置，取出器械（E对）。